下列哪项不是地面水水质卫生标准制定的原则
A. 水量丰富
B. 防止地面水传播疾病
C. 防止地面水引起急、慢性中毒及远期危害
D. 保证地面水自净过程正常进行
E. 保证地面水感观性状良好

正确答案：A。水量丰富

解析：本题考查地面水水质卫生标准制定的原则。地面水水质卫生标准制定的原则包括：防止地面水传播疾病（B对）；防止地面水引起急、慢性中毒及远期危害（C对）；保证地面水自净过程正常进行（D对）；保证地面水感观性状良好（E对）。水量丰富（A错，为本题正确答案）不是地面水水质卫生标准制订的原则。